男，74岁。反复咳嗽，咳痰30年，一周前呼吸道感染入院，自觉胸闷，增加吸氧浓度，出现昏睡，原因为
A. 气胸
B. 血氨升高
C. 二氧化碳潴留
D. 脑器质病变
E. 神经功能障碍

正确答案：C。二氧化碳潴留

解析：患者为老年男性，反复咳嗽、咳痰30年（为慢阻肺的典型表现），考虑诊断为慢性阻塞性肺疾病（COPD）（P23），一周前呼吸道感染入院，自觉胸闷，提示患者诊断应为COPD合并感染，增加吸氧浓度后，出现昏睡，最可能的原因为二氧化碳潴留（C对）。因为患者长时间CO₂潴留，已经对CO₂发生适应，此时机体的呼吸运动主要靠低PaO₂对外周化学感受器的刺激作用来维持，增加吸氧浓度后，PaO₂对外周化学感受器的刺激作用消失，患者发生呼吸抑制，出现CO₂麻醉（患者出现昏睡的症状）。气胸（P120）（A错）常表现为肺容积减小，肺活量减低，最大通气量降低的限制性通气功能障碍，导致肺通气量减小，但肺血流量不减少，产生通气/血流比例失调，而通气/血流比例失调一般只引起低氧血症而不伴有二氧化碳潴留，此时高浓度吸氧是有利于低氧血症的缓解，并不会产生呼吸抑制。血氨升高（B错）通常为肝性脑病（P408）的典型生化特征，肝性脑病通常由于肝硬化、重症肝炎、爆发性肝衰竭等病因引起，本病患者无明显病因，故不作为患者昏睡首选原因原因。脑器质病变及神经系统功能障碍会引起呼吸运动障碍，导致通气功能障碍，会引起二氧化碳潴留和低氧血症，但是患者通常会有长期精神改变（如智能障碍、遗忘、意识障碍等）和神经系统症状（如疼痛及感觉异常、皮肤及附属器障碍等），题干中为明确表明患者出现这类症状，因此不作为首选原因（DE错）。